具有心脏毒性的抗肿瘤药是
A. 柔红霉素
B. 长春新碱
C. 紫杉醇
D. 博来霉素
E. 环磷酰胺

正确答案：A。柔红霉素

解析：本题考查抗肿瘤药的典型不良反应。具有心脏毒性的抗肿瘤药是柔红霉素（A对）。柔红霉素为蒽环类抗肿瘤抗生素，其毒性主要是骨髓抑制和心脏毒性。长春新碱（B错）典型不良反应为神经毒性。紫杉醇（C错）典型不良反应为超敏反应。博来霉素（D错）典型不良反应为肺毒性。环磷酰胺（E错）典型不良反应为出血性膀胱炎。